男，46岁。突发剧烈疼痛，呈撕裂状，累及胸骨后及上腹部，伴大汗，持续1小时不缓解。既往高血压病史5年。查体：BP200/110mmHg，双肺呼吸音清，心率100次/分，心律齐，心脏各瓣膜区听诊未闻及杂音，心电图：左室高电压伴V4~V6导联ST段压低0.1mV。该患者最可能的诊断是
A. 张力性气胸
B. 不稳定型心绞痛
C. 急性心肌梗死
D. 肺动眿栓塞
E. 主动脉夹层

正确答案：E。主动脉夹层

解析：46岁中年男性，突发剧烈疼痛（是主动脉夹层最主要和最常见的临床表现），呈撕裂状，累及胸骨后及上腹部，伴大汗，持续1小时不缓解。既往高血压病史（是主动脉夹层最重要的危险因素），查体：BP200/110mmHg（正常值为90～140/60～90mmHg），心电图：左室高电压伴V4～V6导联ST段压低0.1mV（提示左心室心肌缺血），综合该患者的临床表现、查体、心电图检查，该患者诊断考虑为主动脉夹层（E对）。张力性气胸（A错）多有外伤史，表现为严重或极度呼吸困难、烦躁、意识障碍、大汗淋漓、发绀。气管明显移向健侧，颈静脉怒张，多有皮下气肿。伤侧胸部饱满，叩诊呈鼓音，呼吸音消失。不稳定性心绞痛（B错）患者的胸痛一般<30分钟，大多数病人胸痛发作时有一过性ST段（抬高或压低）和T波（低平或倒置）改变。急性心肌梗死（C错）心电图的典型表现为ST段明显弓背向上抬高。肺动眿栓塞（D错）主要表现为胸痛、呼吸困难、咯血和休克。